下列区域性的中小学生卫生保健机构的主要任务，不包括
A. 调查研究本地区中小学生体质健康状况
B. 开展中小学生常见疾病的预防与矫治
C. 指导本地区中小学校，开展爱国卫生运动
D. 开展中小学生卫生技术人员的技术培训
E. 开展中小学生卫生技术人员的任务指导

正确答案：C。指导本地区中小学校，开展爱国卫生运动